风湿马钱片具有祛风除湿、活血祛瘀、通络止痛的作用，用于风湿闭阻、瘀血阻络所致的痹病。处方组成：马钱子粉125g、炒僵蚕19g、乳香（炒）19g、没药（炒）19g、全蝎19g、牛膝19g、苍术19g、麻黄19g、甘草19g。制法：以上九味全蝎、乳香、没药和炒僵蚕粉碎成细粉；麻黄、苍术分别用70%乙醇作溶剂进行渗漉，收集漉液约180ml，回收乙醇浓缩成稠膏；甘草和牛膝加水煎煮三次煎液滤过滤液合并浓缩成稠膏，与上述稠膏合并，加入马钱子粉及全蝎等四味药的细粉，混匀制成颗粒，干燥压制成1000片包糖衣即得。不同类型的中药片剂其崩解时限不同，按《中国药典》规定，风湿马钱片的崩解时限应为
A. 0.5小时内
B. 0.75小时内
C. 1.5小时内
D. 1小时内
E. 2小时内

正确答案：D。1小时内

解析：本题考查的是片剂的崩解时限。不同类型的中药片剂其崩解时限不同，按《中国药典》规定，风湿马钱片的崩解时限应为1小时内（D对）。风湿马钱片胃浸膏片且包有糖衣，应在1小时内全部崩解。片剂的崩解时限：除另有规定外，药材原粉片6片均应在30分钟内（A错）全部崩解；浸膏（半浸膏）片、糖衣片各片均应在1小时内全部崩解。薄膜衣片在盐酸溶液（9→1000）中检查，化药片应在30分钟内全部崩解；中药片应在1小时内全部崩解。含片的溶化性照崩解时限检查法检查，各片均不应在10分钟内全部崩解或溶化。舌下片各片均应在5分钟内全部崩解并溶化。可溶片各片均应在3分钟内全部崩解并溶化。口崩片应在60秒内全部崩解并通过筛孔内径为710μm的筛网。肠溶片先在盐酸溶液（9→1000）中检查2小时，每片均不得有裂缝、崩解或软化现象，再在磷酸盐缓冲液（pH6.8）中进行检查，1小时内应全部崩解。结肠定位肠溶片照各品种项下规定检查，各片在盐酸溶液（9→1000）及pH6.8以下的磷酸盐缓冲溶液中均应不得有裂缝、崩解或软化现象，在pH7.5～8.0的磷酸盐缓冲液中1小时内应完全崩解。泡腾片置盛有200ml水（水温为20℃±5℃）的烧杯中，有许多气泡放出，当片剂或碎片周围的气体停止逸出时，片剂应溶解或分散在水中，无聚集的颗粒剩留，除另有规定外，各片均应在5分钟内崩解。咀嚼片、以冷冻干燥法制备的口崩片以及规定检查溶出度、释放度的片剂，一般不再进行崩解时限检查。